下面哪种情况需要暂缓结婚
A. 精神病患者在发病期间
B. 精神病患者病情稳定满2年
C. 三代以内的旁系血亲
D. 无法治疗的生殖器官畸形
E. 痴呆患者

正确答案：A。精神病患者在发病期间

解析：本题考查有关精神病与婚育的相关内容。精神分裂症患者处于发病期（A对）应暂缓结婚。精神分裂症患者病情稳定2年以上，可以结婚，如果一、二级亲属中有精神分裂症患者，不宜生育；精神分裂症患者病情稳定2年（B错）以上，而且一、二级亲属中没有精神分裂症患者，可以结婚生育。三代以内的旁系血亲（C错）禁止结婚。无法治疗的生殖器官畸形（D错）不宜结婚。痴呆患者（E错）不宜结婚。